分子中含有咪唑并吡啶结构的药物是
A. 唑吡坦
B. 硫喷妥钠
C. 硝西泮
D. 氟西汀
E. 舒必利

正确答案：A。唑吡坦

解析：本题考查非苯二氮䓬类药物。唑吡坦（A对）为非苯二氮䓬结构的镇静催眠药，分子中含有咪唑并吡啶结构。硫喷妥钠（B错）为巴比妥类抗癫痫药物，结构中含有丙二酰脲，其中2位O原子被S原子取代，脂溶性增加。硝西泮（C错）为苯并二氮䓬类镇静催眠药物，为地西泮A环的7位上引入了吸电子的硝基的产物。氟西汀（D错）为5-HT再摄取抑制剂，通过选择性抑制中枢对5-HT的再吸收，发挥抗抑郁作用，分子中不含有咪唑并吡啶结构。舒必利（E错）为非典型的抗精神病药，结构中含有苯磺酰胺结构，不含有咪唑并吡啶结构。